下列描述正确的是
A. 接种单位接种第一类疫苗不得收取任何费用
B. 接种单位接种第一类疫苗只收取接种耗材费
C. 接种单位接种第一类疫苗只收服务费
D. 接种单位接种疫苗不得收取任何费用
E. 接种单位接种第二类疫苗只可以收取接种耗材费

正确答案：A。接种单位接种第一类疫苗不得收取任何费用